由经营者自主制定，通过市场竞争形成的价格是
A. 政府指导价
B. 政府定价
C. 集中招标采购
D. 市场调节价
E. 调节价

正确答案：D。市场调节价